“诸热之而寒者，取之阳”是指
A. 阴病治阳
B. 阴中求阳
C. 因寒用热
D. 寒者热之
E. 用热远热

正确答案：A。阴病治阳

解析：《素问·至真要大论》：“诸寒之而热者取之阴，热之而寒者取之阳，所谓求其属也”，意思为：用寒凉药治疗热证而热仍不退者（说明此热并非“实热”，而应是“虚热”，即阴虚而热），当考虑从阴治疗；用温热药治疗寒证而寒不除者（说明此寒并非“实寒”，而应是“虚寒”，即阳虚而寒），当考虑从阳治疗，即所谓治病求本。其内涵为：当阴偏衰，无力制阳，则会致使阳相对偏亢而产生“阴虚则热”的虚热证，此时，“热”为现象，阴虚才是本质，故当予以滋阴才能阴阳平衡，而虚热消，即“壮水之主，以制阳光”，《素问》将其称之为“阳病治阴”；同理，当阳偏衰，无力制阴，则会致使阴相对偏亢而产生“阳虚则寒”的虚寒证，此时，“寒”为现象，阳虚才是本质，故当予以补阳才能阴阳平衡，而虚寒消，即“益火之源，以消阴翳”，《素问》将其称之为“阴病治阳”（A对）。